男，59岁。头痛、头晕1周。感恶心，未呕吐。既往有支气管哮喘、痛风病史。查体：BP160/80mmHg，心率55次/分，律齐，该患者宜首选的降压药物是
A. 氨氯地平
B. 卡维他洛
C. 维拉帕米
D. 美托洛尔
E. 氢氯噻嗪

正确答案：A。氨氯地平

解析：患者老年男性，有支气管哮喘、痛风病史。查体见BP160/80mmHg（二级高血压，正常血压低于120/80mmHg），心率55次/分，律齐（窦性心动过缓，正常心率60～100次/分）。根据病史、体格检查可以诊断患者有支气管哮喘、痛风、窦性心动过缓。氨氯地平（A对）为长效钙通道阻滞剂，对血脂血糖无明显影响，尤其适用于老年患者或合并糖尿病、冠心病和外周血管病患者；长期治疗还具有抗动脉粥样硬化作用。维拉帕米为非二氢吡啶类钙通道阻滞剂，非二氢吡啶类抑制心肌收缩和传导功能不宜在心力衰竭，窦房结功能低下或心脏传导阻滞患者中应用（C错）。卡维他洛和美托洛尔为β受体拮抗剂（P253）β受体拮抗剂对老年高血压疗效相对较差。易导致心动过缓和一些影响生活质量的不良反应。不良反应主要有心动过缓，乏力，四肢发冷。对心肌收缩力，窦房结及房室结功能均有抑制作用，并可增加气道阻力（BD错）。氢氯噻嗪（E错）是噻嗪类利尿剂，利尿剂（P253）主要不良反应是低血钾症和影响血脂，血糖，血尿酸代谢，痛风患者禁用。